增加左旋多巴疗效，减少不良反应的药物是
A. 卡比多巴
B. 维生素B6
C. 利血平
D. 苯海索
E. 苯乙肼

正确答案：A。卡比多巴

解析：卡比多巴不能通过血脑屏障，与L-DOPA合用时，仅能抑制外周AADC，此时，由于L-DOPA在外周的脱羧作用被抑制，进入中枢神经系统的L-DOPA增加，使用量可减少75%，而使不良反应明显减少，症状波动减轻。本品与L-DOPA组成的复方制剂称为心宁美（sinemet），现有心宁美控释剂（sinemet　CR）。掌握“左旋多巴、卡比多巴、苯海索”知识点。